戊型肝炎病毒（HEV）的主要传播途径是
A. 消化道传播
B. 输血传播
C. 虫媒传播
D. 呼吸道传播
E. 直接接触传播

正确答案：A。消化道传播

解析：戊型肝炎病毒主要通过粪-口途径的消化道传播，即消化道传播（A对），其传播途径与甲型肝炎相似。可经输血传播（B错）的肝炎病毒有乙型肝炎、丙型肝炎、丁型肝炎（P22-P23），艾滋病等疾病也可经血液传播。虫媒传播（C错）是流行性乙型脑炎病毒等病原体的传播途径（P86）。呼吸道传播（D错）是流感病毒，鼻病毒等病原体的传播途径（P7）。直接接触传播（E错）是钩端螺旋体、钩虫等病原体的传播途径（P7）。